香连片的功能是
A. 健脾温肾，涩肠止泻
B. 解肌，清热，止泻
C. 清热燥湿，行气止痛
D. 补中益气，健脾和胃
E. 健脾和胃，涩肠止泻

正确答案：C。清热燥湿，行气止痛

解析：本题考查的是香连丸的功能。香连片的功能是清热化湿，行气止痛（C对）。香连丸：【功能】清热化湿，行气止痛。固本益肠片：【功能】健脾温肾，涩肠止泻（A错）。葛根芩连丸：【功能】解肌透表，清热解毒，利湿止泻（B错）。养胃舒胶囊：【功能】益气养阴，健脾和胃，行气导滞。全方配伍，补中兼消，共奏益气养阴、健脾和胃（D错）、行气导滞之功。功能为健脾和胃，涩肠止泻（E错）的中成药，2022年考试指南未明确说明。